位于后索内侧部的是
A. 楔束
B. 红核脊髓束
C. 皮质脊髓束
D. 脊髓丘脑束
E. 薄束

正确答案：E。薄束

解析：楔束（A错）位于后索的外侧部，薄束（E对）占据后索的内侧部，红核脊髓束（B错）在脊髓外侧索内下行， 脊髓丘脑束（D错）分为脊髓丘脑侧束和脊髓丘脑前束，脊髓丘脑侧束位于外侧索的前半部，脊髓丘脑前束位于前索，皮质脊髓束（C错）分为皮质脊髓侧束和皮质脊髓前束，前者在脊髓外侧索后部下行，后者在在前索最内侧下行。